降血糖的药是
A. 格列齐特
B. 苯海索
C. 丙咪嗪
D. 氯苯那敏
E. 甲基多巴

正确答案：A。格列齐特

解析：本题考查降糖药。降血糖的药是格列齐特（A对）。苯海索（B错）为治疗帕金森的药物。丙咪嗪（C错）为三环类抗抑郁药。氯苯那敏（D错）为组胺H₁受体拮阻断药。甲基多巴（E错）主要用于治疗高血压。